釉质钙化不全与浅龋的区别
A. 前者釉质脱矿造成，后者有细菌的作用
B. 釉质有机物支架有无分解
C. 白垩状损害，但前者表面光洁
D. 白垩状损害，但前者可在牙面任何部位，后者有好发部位
E. C+D

正确答案：E。C+D

解析：本题考查浅龋与釉质发育不全的鉴别。浅龋与釉质发育不全相鉴别，浅龋一般呈白垩状点或斑，早期不易察觉。釉质钙化不全亦表现有白垩状损害，表面光洁（C对），同时白垩状损害可出现在牙面任何部位，浅龋有一定的好发部位（D对）。（CD 均对，故E为本题的正确答案）。釉质钙化不全是釉质矿化不良所致，浅龋有细菌的作用（A错）。釉质有机物支架分解二者均可发生，因此无法鉴别（B错）。